卵巢内胚窦瘤标记物是
A. 血清β-hCG
B. 血清雌激素
C. 血清CA125
D. 血清AFP
E. 血清雄激素

正确答案：D。血清AFP

解析：卵巢内胚窦瘤标记物是血清AFP（甲胎蛋白）（D对），用于诊断和病情监测。血清CA125（C错）为卵巢上皮性癌的标记物。血清β-hCG（A错）对非妊娠性卵巢绒癌有特异性。颗粒细胞瘤、卵泡膜细胞瘤产生较高水平雌激素，浆液性、黏液性囊腺瘤或勃勒纳瘤有时也可分泌一定量雌激素。高水平雌激素（B错）可用于颗粒细胞瘤、卵泡膜细胞瘤的诊断。血清雄激素（P330）（E错）为支持细胞-间质细胞瘤的标记物。支持细胞-间质细胞瘤又称睾丸母细胞瘤，可分泌雄激素，有男性化作用。